若釉板的成因是由于釉柱成熟不足，则其中的哪种物质含量较高
A. 胶原纤维
B. 釉原蛋白
C. 钙化小球
D. 非釉原蛋白
E. 釉原蛋白酶

正确答案：B。釉原蛋白

解析：釉板的发生可能来自于一组釉柱的成熟不全，此情况下釉原蛋白的含量较高。掌握“牙釉质”知识点。